患者，女，35岁。关节肿胀疼痛，痛有定处，晨僵，屈伸不利，遇寒痛剧，局部畏寒怕冷，舌苔薄白，脉沉紧诊断为类风湿关节炎，治疗应首选.
A. 大秦艽汤
B. 宣痹汤
C. 蠲痹汤
D. 三痹汤
E. 白虎加桂枝汤

正确答案：C。蠲痹汤

解析：本题痹证为患者，为风寒湿痹，治应祛风散寒除湿通络，用蠲痹汤（C对）加减。大秦艽汤（A错）主治中风，风中于络，用其祛风清热，养血活血之功。宣痹汤（B错）合三妙散治疗类风湿性关节炎之湿热痹阻证，以其清热除湿，祛风通络之效。三痹汤（D错）主治肝肾气血不足，风寒湿痹之虚实夹杂者，功效为活血祛风，散寒除湿。白虎加桂枝汤（E错）治风湿热痹证，以其清热通络，祛风除湿。